患者，男，70岁，典型的“面具脸”“慌张步态”表现，临床诊断为帕金森病，患者同时患有前列腺增生，不宜选用的药物是
A. 普拉克索
B. 苯海索
C. 卡比多巴
D. 甲基多巴
E. 金刚烷胺

正确答案：B。苯海索

解析：本题考查抗帕金森病用药。苯海索（B错，为本题正确答案）为抗胆碱能类抗抑郁药，可使膀胱逼尿肌松弛，引起小便不畅，甚至尿潴留，因此前列腺增生患者禁用。普拉克索（A对）为多巴胺受体激动剂。卡比多巴（C对）主要与左旋多巴合用治疗帕金森病。甲基多巴（D对）用于妊娠期高血压。金刚烷胺（E对）哺乳期妇女禁用，肾功能不全、癫痫、严重胃溃疡、肝病患者慎用。